花粉粒极面观呈三角形，赤道面观呈双凸镜形，具三副合沟的药材是
A. 金银花
B. 洋金花
C. 丁香
D. 红花
E. 菊花

正确答案：C。丁香

解析：本题考查的是丁香的显微鉴别。花粉粒极面观呈三角形，赤道面观呈双凸镜形，具三副合沟的药材是丁香（C对）。丁香【显微鉴别】粉末花粉粒众多，极面观三角形，赤道面观双凸镜形，具3副合沟。纤维梭形，顶端钝圆，壁较厚。草酸钙簇晶众多，直径4～26㎛，存在于较小的薄壁细胞中，常数个排列成行。油室多破碎，含油状物。金银花（A错）【显微鉴别】粉末花粉粒类球形，表面具细密短刺及细颗粒状雕纹，具3个萌发孔。腺毛较多，头部倒圆锥形、类圆形或略扁圆形，多细胞，柄部亦为多细胞。非腺毛为单细胞，有一种甚长而稍弯曲，壁薄，有微细疣状突起；一种较短，壁厚，具壁疣，有的可见螺纹。洋金花（B错）【显微鉴别】粉末花粉粒类球形或长圆形，直径42～65㎛，表面有条纹状雕纹。花萼、花冠裂片边缘、花丝基部均具非腺毛。花萼、花冠薄壁细胞中有草酸钙砂晶、方晶及簇晶。红花（D错）【显微鉴别】粉末花粉粒类圆球形或椭圆形，直径约至60㎛，外壁有刺或具齿状突起，具3个萌发孔。花冠、花丝、柱头碎片多见，有长管状分泌细胞，常位于导管旁，直径约66㎛，含黄棕色至红棕色分泌物。菊花（E错）【显微鉴别】粉末：淡黄色。①花粉粒黄色类球形，外壁较厚，具粗齿，有3个萌发孔。②无柄腺毛鞋底形，4～6个细胞，两两相对排列，外被角质层。③花冠表皮细胞垂周壁波状弯曲，平周壁有细密的放射状条纹。④花粉囊内壁细胞壁呈网状或条状增厚。